第四代头孢菌素的特点有
A. 对革兰阴性菌作用强
B. 对革兰阳性菌作用增强
C. 对β-内酰胺酶稳定
D. 无肾毒性
E. 可作为第三代头孢菌素替代药

正确答案：A、B、C、D、E。对革兰阴性菌作用强；对革兰阳性菌作用增强；对β-内酰胺酶稳定；无肾毒性；可作为第三代头孢菌素替代药

解析：本题考查第四代头孢菌素的特点。第四代头孢菌素对革兰阳性菌、革兰阴性菌、厌氧菌活性强（A对），且与第三代比，抗革兰阳性菌活性增强（B对）。对β-内酰胺酶稳定（C对），无肾毒性（D对）。可用于对第三代头孢菌素耐药的革兰阴性杆菌引起的重症感染（E对）。